胰头癌最常主要的临床表现是
A. 上腹痛
B. 黄疸
C. 腹胀
D. 便秘
E. 消化不良

正确答案：B。黄疸

解析：黄疸（B对）是胰头癌最主要的临床表现，多数是由胰头癌压迫或浸润胆总管所致，呈进行性加重。黄疸出现的早晚和肿瘤的位置密切相关，癌肿距离胆总管越近，黄疸出现越早。胆道梗阻越完全，黄疸越深。上腹痛（A错）是胰头癌常见的首发症状。胰头癌可出现腹胀（C错）、便秘（D错）、消化不良（E错）等消化道症状，但并非最主要临床表现。